防治静脉血栓的口服药物是
A. 尿激酶
B. 链激酶
C. 华法林
D. 低分子肝素
E. 草酸钾

正确答案：C。华法林

解析：本题考查防治静脉血栓药物的给药方式。防治静脉血栓的口服药物是华法林（C对）。华法林是口服药，可用于防治静脉血栓。尿激酶（A错）、链激酶（B错）、低分子肝素（D错）、草酸钾（E错）是注射药。